下列骨纤维异常增生症的描述中，哪项是错误的
A. 病变内大量纤维组织
B. 病变内大量成纤维细胞
C. 病变内形成囊腔
D. 病变内新骨形成
E. 病变包膜完整

正确答案：E。病变包膜完整

解析：本题考查纤维结构不良（骨纤维异常增生症）的病理变化。骨纤维异常增生症的描述中错误的是病变包膜完整（E错，为本题的正确答案）。骨纤维异常增生症又称纤维结构不良，是一种良性自限性但无包膜的病损。镜下见疏松的细胞性纤维组织（A对）代替了正常骨组织，纤维组织背景下可见呈均匀分布、形态不一的编织状骨小梁，这些骨小梁的周围往往缺乏成排的成骨细胞，骨小梁之间的胶原纤维排列疏松或呈旋涡状，成纤维细胞（B对）大小一致，呈梭形或星形。病变内可形成囊腔（C对），囊内为淡黄色液体。增生的纤维结缔组织中富含血管，有时还可见到骨样组织，可见新骨形成（D对）。